桡骨下段骨折首选的治疗方法是
A. 切开复位钢板内固定
B. 抗炎镇痛
C. 中药活血化瘀
D. 手法复位外固定
E. 直接支具外固定

正确答案：D。手法复位外固定

解析：桡骨远端骨折分为伸直型骨折和屈曲型骨折，二者均首选手法复位外固定（D对）；仅在手法复位不成功或外固定不能维持复位时采取切开复位钢板内固定（A错）。消炎镇痛（B错）及中药活血化瘀（C错）对骨折而言主要为辅助保守治疗。直接支具外固定（E错）仅适用于无位移骨折。